应对应激以减轻紧张的措施是
A. 分散对消极应激源的注意
B. 努力忘却消极应激源的情景状态
C. 增加对威胁情境的回避能力
D. 利用各种放松技术
E. 锻炼意志

正确答案：D。利用各种放松技术